下列关于切开法切开方向的叙述，错误的是
A. 一般疮疡，宜循经直开，刀头向上
B. 乳部宜放射形切开
C. 面部脓肿沿皮肤纹理切开
D. 手指脓肿，最好从正面切开，免伤屈伸功能
E. 关节附近宜用横切口

正确答案：D。手指脓肿，最好从正面切开，免伤屈伸功能

解析：切开法切口的选择：手指脓肿应从侧方切开（D错，为本题正确答案）。切口选择为便于引流，切口应选择脓腔最低点或最薄弱处进刀，一般疮疡宜循经直切，免伤血络（A对）；乳房部应以乳头为中心做放射状切开，免伤乳络（B对）；面部脓肿应尽量沿皮肤的自然纹理切开（C对）；关节区附近的脓肿切口尽量避免越过关节；若为关节区脓肿一般施行横切口（E对）、弧形切口或"S"形切口，因为纵切口在疤痕形成后易影响关节功能；肛旁低位脓肿应以肛管为中心做放射状切开。本题问的是错误的选项，故选D。